肝素过量所致出血的解救药物是
A. 蛇毒血凝酶
B. 维生素K
C. 鱼精蛋白
D. 酚磺乙胺
E. 氨甲环酸

正确答案：C。鱼精蛋白

解析：本题考查肝素过量所致出血的解救药物。鱼精蛋白（C对）是肝素过量所致出血的解救药物。维生素K（B错）可以对抗华法林使用过量。蛇毒血凝酶（A错）用于出血及出血性疾病，也可用来预防手术部位及手术后出血。酚磺乙胺（D错）是临床上常用的止血药,也可以预防术后出血。氨甲环酸（E错）为氨基酸类抗纤溶酶药，用于防治急性、慢性、局限性或全身性原发性纤维蛋白溶解亢进所致的各种出血。